三种现象均属于药物制剂化学稳定性变化的是
A. 乳剂分层、混悬剂结晶生长、片剂溶出速度改变
B. 药物水解、结晶生长、颗粒结块
C. 药物氧化、颗粒结块、溶出速度改变
D. 药物降解、乳液分层、片剂崩解度改变
E. 药物水解、药物氧化、药物异构化

正确答案：E。药物水解、药物氧化、药物异构化

解析：本题考查药物制剂的稳定性。药物水解、药物氧化、药物异构化（E对）这三种现象均属于药物制剂化学稳定性变化。药物制剂稳定性变化一般包括物理、化学和生物学三个方面。化学不稳定性是指药物由于水解、氧化、异构化、还原、光解、聚合、脱羧，以及药物相互作用产生的化学反应，使药物含量、色泽发生变化。物理不稳定性是指制剂物理性能发生变化，如乳剂的分层（A错）、破裂，混悬剂中药物颗粒结块、结晶生长（B错），片剂崩解度（D错）、溶出速度改变（C错）等。生物不稳定性是指由于微生物污染滋长，引起药物的酶败分解变质。